判定某地区人群有慢性镉危害，应具备的条件为
A. 尿镉15μg/g肌苷
B. 尿β₂-微球蛋白1000μg/g肌苷
C. 尿NAG酶（DAG酶-乙酰-βD-氨基葡萄糖苷酶）17U/g肌苷
D. 出现10%联合反应率
E. 包括上述各项

正确答案：E。包括上述各项

解析：本题考查判定某地区人群有慢性镉危害应具备的条件。判定某地区人群有慢性镉危害，应具备的条件为：1.尿镉15μg/g肌苷；2.尿β₂-微球蛋白1000μg/g肌苷；3.尿NAG酶（DAG酶-乙酰-βD-氨基葡萄糖苷酶）17U/g肌苷；4.出现10%联合反应率（E对ABCD错）。